去甲肾上腺素激动作用强大，针对的是下列哪种受体
A. β受体
B. γ受体
C. δ受体
D. ε受体
E. α受体

正确答案：E。α受体

解析：去甲肾上腺素激动α受体作用强大，对α1和α2受体无选择性。掌握“去甲肾上腺素”知识点。